欲了解更多的药品不良反应信息，可优先查阅的文献是
A. 《中国国家处方集》
B. 《中华人民共和国药典》
C. 《新编药物学》
D. 《梅氏药物副作用》
E. 《马丁代尔药物大典》

正确答案：D。《梅氏药物副作用》

解析：本题考查药物信息咨询服务常用资料。《梅氏药物副作用》（D对）按照药学分类编写，提供对各国药品不良事件文献的汇总和分析性评论。《中国国家处方集》（A错）以优先使用基本药物为药物选用原则，充分结合各专业临床经验和国际共识，就临床上常见的20个医学系统的199种常见疾病的药物治疗方案提出了选药原则和用药指导。《中华人民共和国药典》（B错）对适应近年来药品迅速发展的形式，指导合理用药具有较大的参考价值。《新编药物学》 （C错）对国内外常用药品的性状、药理及应用、用法、注意事项及制剂均有简略的介绍。《马丁代尔药物大典》（E错）这部教科书数据库中的每个药物条目不仅提供用法用量、不良反应、药动学、相互作用、妊娠及哺乳期用药等常用信息，还可方便快捷地检索药品的分子式、同义名、商品名及制造商信息。